某女，50岁。瘰疬初起，外寒内热，表里俱实，症见恶寒壮热、头痛咽干、小便短赤、大便秘结，治当解表通里，清热解毒，宜选用的成药是
A. 防风通圣丸
B. 当归龙荟丸
C. 通便灵胶囊
D. 双清口服液
E. 葛根芩连丸

正确答案：A。防风通圣丸

解析：本题考查的是防风通圣丸的功能。瘰疬初起，外寒内热，表里俱实，症见恶寒壮热、头痛咽干、小便短赤、大便秘结，治当解表通里，清热解毒，宜选用的成药是防风通圣丸（A对）。防风通圣丸：【功能】解表通里，清热解毒。当归龙荟丸（B错）：【功能】泻火通便。通便灵胶囊（C错）：【功能】泻热导滞，润肠通便。双清口服液（D错）：【功能】疏透表邪，清热解毒。葛根芩连丸（E错）：【功能】解肌透表，清热解毒，利湿止泻。